根据执业药师注册管理的相关规定，取得执业药师资格证书并经注册后方可执业，下列属于执业单位的有
A. 药品连锁企业总部
B. 药品检验机构
C. 药品批发企业
D. 医疗机构

正确答案：A、C、D。药品连锁企业总部；药品批发企业；医疗机构

解析：本题考查执业药师的注册执业单位。根据执业药师注册管理的相关规定，取得执业药师资格证书并经注册后方可执业，下列属于执业单位的有药品连锁企业总部（A对）、药品批发企业（C对）、医疗机构（D对）。机关、院校、科研单位、药品检验机构（B错）不属于规定的注册执业单位。